高渗性非酮症糖尿病昏迷治疗的关键是
A. 降糖
B. 控制饮食
C. 纠正酸碱平衡
D. 补液
E. 消除诱因

正确答案：D。补液

解析：高渗性非酮症糖尿病昏迷是因高血糖引起的血浆渗透压增高，以严重脱水和进行性意识障碍为特征的临床综合征。治疗当补液、应用胰岛素、补钾、积极治疗诱发病和防治并发症。本症比DKA失水更严重，只有在有效组织灌注改善，恢复后，胰岛素的生物生物效应才能充分发挥。因此补液是关键（D对）。